国际检疫传染病有四种，它们是
A. 鼠疫、天花、斑疹伤寒、回归热
B. 霍乱、伤寒、天花、疟疾
C. 流感、天花、霍乱、鼠疫
D. 霍乱、鼠疫、天花、黄热病
E. 鼠疫、天花、霍乱、病毒性肝炎

正确答案：D。霍乱、鼠疫、天花、黄热病

解析：本题考查国际检疫的传染病类型。国际检疫的传染病有四种，分别为：霍乱、鼠疫、天花、黄热病（D对ABCE错）。